女，70岁。间断水肿3年，加重伴乏力1个月。糖尿病病史20年，高血压病史17年。查体：BP175/85mmHg，心率85次／分，心律齐，双下肢中度水肿。实验室检查：SCr465µmol/L，血钾5.8mmol/L。尿RBC（-），蛋白（+++）。以下不适宜选用的降压药物是
A. 血管紧张素Ⅱ受体拮抗剂
B. α受体拮抗剂
C. 钙通道阻滞剂
D. 袢利尿剂
E. β受体拮抗剂

正确答案：A。血管紧张素Ⅱ受体拮抗剂

解析：患者老年女性，高血压间断水肿3年，加重伴乏力1个月。糖尿病病史20年，高血压病史17年。查体：BP175/85mmHg（2级高血压），双下肢中度水肿。实验室检查：SCr465µmol/L（＞265μmol/L，提示肾功能不全），血钾5.8mmol/L（＞5.5mmol/L），尿蛋白（+++）。结合患者病史、查体及实验室检查，诊断为1.2级高血压、很高危；2.糖尿病；3.糖尿病肾病；4.肾功能不全。血管紧张素Ⅱ受体拮抗剂 α受体拮抗剂（B对）、钙通道阻滞剂（C对）、袢利尿剂（D对）、β受体拮抗剂（E对）均可用于老年高血压的降压治疗，血管紧张素Ⅱ受体拮抗剂（A错，为本题正确答案）通过抑制ACE间接抑制肾素-血管紧张素-醛固酮系统（RAAS），有降低肾小球滤过率，升高血钾等副作用，因此，患者血肌酐明显升高（肾功能不全），有高钾血症，禁用ACEI以免加重病情。